生长快，侵袭力强，远处转移早，对化学药物治疗和放射治疗较敏感的是
A. 鳞状上皮细胞癌
B. 细支气管肺泡癌
C. 大细胞未分化癌
D. 腺癌
E. 小细胞未分化癌

正确答案：E。小细胞未分化癌

解析：小细胞肺癌生长较快，倍增时间短，约为25～46天，平均约为30天，分化差，恶性程度高，早期易出现转移，确诊时约有70%～90%的病人已有纵隔淋巴结和（或）胸外器官广泛转移，对化疗、放疗敏感（E对）。鳞癌一般生长缓慢，转移晚，手术切除机会较多，但对放疗和化疗敏感性不如小细胞癌（A错）。肺泡细胞癌或称细支气管-肺泡癌，属于腺癌的一个亚型，其发病年龄较轻，与吸烟关系不大。癌细胞多为分化好的柱状细胞，沿终末细支气管和肺泡壁表面蔓延，不侵犯或破坏肺的结构，可能属一种异源性肿瘤（B错）。大细胞癌：可分为巨细胞型和透明细胞型。癌细胞大，分化差，形态多样，核大，核仁显著，胞浆丰富，有黏液形成。常见大片出血性坏死。大细胞癌较小细胞癌转移晚，手术切除机会较大（C错）。腺癌：包括腺泡状、乳头状、细支气管-肺泡癌和实体癌伴黏液形成。典型腺癌呈腺管或乳头状结构，癌细胞为圆形或柱状，核仁明显，胞浆丰富，常含有黏液，在纤维基质支持下形成腺体状。腺癌女性多见，与吸烟无密切关系，约占原发性肺癌的25%。主要来自支气管腺体，倾向于管外生长，也可循泡壁蔓延，早期即可侵犯血管和淋巴管引起肝、脑、骨等远处转移，更易累及胸膜出现胸腔积液（D错）。